当细胞与细胞、或细菌通过菌毛相互接触时，质粒DNA从一个细胞转移至另一细胞，这种类型的DNA转移称为
A. 转化作用
B. 转导作用
C. 转座作用
D. 接合作用
E. 重组作用

正确答案：D。接合作用

解析：当细胞与细胞、或细菌通过菌毛相互接触时，质粒DNA从一个细胞转移至另一细胞，此种类型的DNA转移称为结合作用。掌握“DNA重组与基因工程”知识点。